大补阴丸的组成药物中含有
A. 黄精
B. 黄芩
C. 黄连
D. 黄柏
E. 黄芪

正确答案：D。黄柏

解析：本题考查大补阴丸的组成，属于记忆内容。大补阴丸由熟地黄、龟板、黄柏、知母、猪脊髓、蜜组成。黄精、黄芩、黄连、黄芪不是大补阴丸的组成药物（ABCE错）。黄柏为大补阴丸的药物组成（D对）。记忆：大补阴丸知柏黄，龟板脊髓蜜丸方，咳嗽咯血骨蒸热，阴虚火旺制阳亢。